磺酰脲类药物引起的不良反应不包括
A. 胆汁淤积性黄疸
B. 突发严重低血糖
C. 高乳酸血症
D. 皮肤过敏
E. 粒细胞减少

正确答案：C。高乳酸血症

解析：二甲双胍类降糖药可促进肌肉组织对葡萄糖的无氧降解，产生过多乳酸，引起高乳酸血症（C错，为本题正确答案）。磺酰脲类药物与胰岛β细胞膜上磺酰脲受体结合，促进胰岛素释放，降低血糖，其不良反应主要有1.应用剂量过大、未按时进餐，可诱发低血糖，引起突发严重低血糖（B对），其中老人和肝、肾功能不全者发生率高。2.消化道反应，一些患者服药后出现恶心、呕吐、腹痛、腹泻。3.大剂量氯磺丙脲可引起精神错乱、嗜睡、眩晕、共济失调等中枢反应。4.可引起皮疹、皮炎等皮肤过敏性反应（D对），也可出现粒细胞减少（E对）、血小板减少、再生障碍性贫血和溶血性贫血、胆汁淤积性黄疸（A对）和肝功能损害等，故长期应用需定期检查血象和肝功能。